继发颌骨畸形的矫治时间是
A. 6个月
B. 12～18个月
C. 学龄前
D. 9～12岁
E. 16岁以后

正确答案：E。16岁以后

解析：继发颌骨畸形的矫治时间是16岁以后（E对）。出生后6个月配戴鼻管以矫治鼻孔畸形（A错）；唇裂修复，单侧3～6个月，双侧6～12个月。腭裂修复术在患儿12～18个月时进行（B错）；牙槽突植骨术于9～12岁时进行（D错）；正颌外科治疗常在16岁以后进行。